女性，25岁，平时月经规则，3个月前妇科检查有小肌瘤，现停经2月余，阴道流血10天。妇科检查子宫如妊娠14周大，软，轻压痛，双侧附件区触及5cm囊性包块，壁薄活动好，无压痛。血HCG增高明显。此例最可能的诊断是
A. 宫外孕
B. 卵巢巧克力囊肿
C. 葡萄胎
D. 子宫肌瘤红色变
E. 早孕合并子宫肌瘤

正确答案：C。葡萄胎

解析：该患者为育龄期女性，平时月经规则，现停经2月余（疑为早孕），阴道流血10天（葡萄胎患者停经8～12周左右开始不规则阴道流血，量多少不定），妇检：子宫如妊娠14周大，软（因葡萄胎迅速增长及宫腔内出血，约半数以上患者的子宫大于停经月份，质地变软），轻压痛，双侧附件区触及5cm囊性包块，壁薄（大量hCG刺激卵巢卵泡内膜细胞发生黄素化形成卵巢黄素化囊肿。常为双侧，活动度好…囊壁薄），活动好，无压痛。血hCG增高明显（葡萄胎患者hCG水平异常升高），最可能的诊断是葡萄胎（C对）。宫外孕（P53）（A错）早期常无特殊的临床表现，与早孕或先兆流产相似，晚期发生破裂时，突感一侧下腹部撕裂样疼痛，伴恶心呕吐，常有不规则阴道流血，妇检子宫大小与停经月份基本相符，hCG水平较宫内妊娠低。卵巢巧克力囊肿（P270）（B错）又称卵巢子宫内膜异位囊肿，是因异位内膜侵犯卵巢皮质并在其内生长、反复周期性出血形成的。典型症状为继发性痛经、进行性加重，双合诊检查时，可发现子宫后倾固定，一侧或双侧附件处触及囊实性包块，活动差。子宫肌瘤红色变（P311）（D错）多发生于妊娠期，可有剧烈腹痛伴恶心、呕吐、发热，白细胞计数升高，检查发现肌瘤迅速增大，无停经2月余后血hCG增高明显（正常妊娠时受精卵着床后的10周血hCG浓度达高峰，持续约10日迅速下降）。早孕合并子宫肌瘤（E错）无停经2月余后血hCG增高明显，因患者为小肌瘤，不会出现子宫如妊娠14周大。